耐药质粒的组成部分是
A. RTF（耐药传递因子）与F因子
B. RTF与耐药（γ）决定因子
C. γ决定因子与gAl基因
D. γ决定因子与Bio基因
E. γ决定因子与F因子

正确答案：B。RTF与耐药（γ）决定因子